服用利血平可能引起
A. 心动过缓
B. 血钾降低
C. 血钾升高
D. 面部潮红
E. 下肢浮肿

正确答案：A。心动过缓

解析：本题考查药物的不良反应。服用利血平可能引起心动过缓（A对）。利血平的不良反应主要包括副交感神经支配现象、精神抑郁和心动过缓等。血钾降低（B错）是呋塞米的不良反应。血钾升高（C错）是ACEI类药物的不良反应。面部潮红（D错）是二氢吡啶类钙通道阻滞剂的不良反应。下肢浮肿（E错）是哌唑嗪的不良反应。